患者平素体虚，昨日又感风寒，症见恶寒发热，头痛鼻塞，咳嗽痰多，胸闷呕逆，乏力气短，宜选用
A. 午时茶颗粒
B. 参苏丸
C. 荆防颗粒
D. 羚翘解毒丸
E. 感冒清热颗粒

正确答案：B。参苏丸

解析：本题考查的是参苏丸主治。患者平素体虚，昨日又感风寒，症见恶寒发热，头痛鼻塞，咳嗽痰多，胸闷呕逆，乏力气短，宜选用参苏丸（B对）。参苏丸：【主治】身体虚弱，感受风寒所致的感冒，症见恶寒发热、头痛鼻塞、咳嗽痰多、胸闷呕逆、乏力气短。午时茶颗粒（A错）：【主治】外感风寒、内伤食积证，症见恶寒发热、头痛身楚、胸脘满闷、恶心呕吐、腹痛腹泻。荆防颗粒（C错）：【主治】外感风寒挟湿所致的感冒，症见头身疼痛、恶寒无汗、鼻塞流涕、咳嗽。感冒清热颗粒（E错）：【主治】风寒感冒，头痛发热，恶寒身痛，鼻流清涕，咳嗽咽干。羚翘解毒丸（D错）的主治，2022年考试指南未明确说明。